胃癌淋巴结转移的常见部位是
A. 右锁骨上
B. 左锁骨上
C. 右颈部
D. 左颈部
E. 左颌下

正确答案：B。左锁骨上

解析：淋巴转移是胃癌的主要转移途径。胃区域淋巴结引流的淋巴液主要经腹腔淋巴结、肠系膜上淋巴结和肠系膜下淋巴结的输出淋巴管汇入肠干，肠干内的淋巴液最终经胸导管注入左静脉角，而胸导管与左锁骨上淋巴结、肋间淋巴结等之间存在着广泛的淋巴侧支通路，因此胃癌淋巴结转移的常见部位是左锁骨上淋巴结（B对）。右侧锁骨上淋巴结转移（A错）多见于胸部肿瘤。右颈部（C错）、左颈部（D错）、左颌下（E错）淋巴结肿大可见于淋巴结炎、淋巴结结核、血液系统原发性恶性肿瘤等。